较易发生DIC的休克类型是
A. 心源型休克
B. 失血性休克
C. 过敏性休克
D. 感染性休克
E. 神经源性休克

正确答案：D。感染性休克

解析：严重感染（D对ABCE错）或烧伤引起的休克，即感染性休克，可直接进入微循环衰竭期，较易发生DIC或多器官功能障碍。